能止汗的是
A. 人参
B. 甘草
C. 白术
D. 山药
E. 大枣

正确答案：C。白术

解析：本题考查的是白术的功效。能止汗的是白术（C对）。白术：【功效】补气健脾，燥湿利水，止汗，安胎。人参（A错）：【功效】大补元气，补脾益肺，生津止渴，安神益智。甘草（B错）：【功效】益气补中，祛痰止咳，解毒，缓急止痛，缓和药性。山药（D错）：【功效】益气养阴，补脾肺肾，固精止带。大枣（E错）：【功效】补中益气，养血安神，缓和药性。